对诊断消化性溃疡穿孔最有价值的临床表现是
A. 突发上腹部剧痛
B. 腹式呼吸消失
C. 上腹部压痛明显
D. 上腹部有反跳痛
E. 肝浊音界消失

正确答案：E。肝浊音界消失

解析：消化性溃疡穿孔后，消化道内气体进入腹腔积聚在右膈下，导致肝浊音界消失（E对），诊断特异性强，为诊断消化性溃疡穿孔最有价值的临床表现。消化性溃疡穿孔的后，胃肠内的消化液进入腹腔，引起腹膜炎，表现为突发上腹部剧痛（A错）、腹式呼吸消失（B错）、上腹部压痛明显（C错）及上腹部有反跳痛（D错），但特异性较差。